男，38岁，某钢铁厂煤炉车间平车工，工作期间头痛，头晕，面色潮红，大量出汗，脉搏加速，38℃，首要救助措施
A. 按压人中
B. 灌注清凉饮料
C. 酒精擦浴
D. 静脉注射氯丙嗪
E. 脱离工作环境

正确答案：E。脱离工作环境

解析：患者男，38岁，某钢铁厂煤炉车间平车工，工作期间头痛，头晕，面色潮红，大量出汗，脉搏加速，38℃，结合患者的年龄、职业、表现，提示为中暑，脱离工作环境是首要救助措施（E对）。其余选项均不属于中暑的治疗措施(ABCD错)。